治疗月经周期不规律，经量少，色淡，腰骶酸痛，头晕，舌淡苔白，脉沉弱，针灸治疗应选取哪组经脉为主
A. 任脉、足少阴经
B. 任脉、足厥阴经
C. 任脉、足太阴经
D. 带脉、冲脉、任脉
E. 任脉、督脉、冲脉

正确答案：C。任脉、足太阴经

解析：月经不调基本治疗应以任脉及足太阴经穴为主（C对）。月经不调，（270）“病位在胞宫，与冲、任脉及肾、脾、肝三脏关系密切”，与带脉、督脉关系并不密切（DE错），虽与肾、脾、肝三脏都有关，但治疗时要选脾经穴为主来调补气血，况此证为脾虚气血不足证，更应选择任脉及足太阴经穴为主进行治疗（C对）。